流感、甲型肝炎、乙型脑炎疫苗属于
A. 灭活疫苗
B. 减毒活疫苗
C. 类毒素疫苗
D. 亚单位疫苗
E. 偶联疫苗

正确答案：A。灭活疫苗

解析：灭活疫苗，又称死疫苗，是采用灭活病原微生物为抗原制成的疫苗。灭活病原微生物的方法有加热、化学处理和辐射。目前仍使用的灭活疫苗有伤寒、百日咳、霍乱、脊髓灰质炎、流感、狂犬病、甲型肝炎、乙型脑炎和钩端螺旋体疫苗。掌握“免疫预防及免疫治疗”知识点。